用酒精给高热病人擦浴的散热方式是
A. 蒸发散热
B. 辐射散热
C. 不感蒸发散热
D. 传导散热
E. 对流散热

正确答案：A。蒸发散热

解析：蒸发散热（A对）是指水分从体表汽化时吸收热量而散发体热的一种方式。蒸发散热可分为不感蒸发和发汗两种形式。不感蒸发（C错）是指体内的水从皮肤和黏膜（主要是呼吸道黏膜）表面不断渗出而被汽化的过程。由于这种蒸发不被人们所察觉，且与汗腺活动无关，故得此名，其中水从皮肤表面的蒸发又称不显汗。辐射散热（B错）是指机体通过热射线的形式将体热传给外界冷物质的一种散热形式，人体在21℃的环境中，在裸体情况下约有60%的热量是通过辐射散热方式发散的。传导散热（D错）是指机体的热量直接传给与之接触的温度较低物体的一种散热方式。对流散热（E错）是指通过气体流动而实现热量交换的一种散热方式，通过对流散失热量的多少，除取决于皮肤与周围环境之间的温度差和机体的有效散热面积外，受风速影响较大，风速越大，散热量就越多；反之，风速越小，散热量也越少。